肠系膜下动脉起始部闭塞，可能出现血运障碍的部位是
A. 十二指肠和胰
B. 空肠和回肠
C. 升结肠和横结肠
D. 阑尾
E. 降结肠和乙状结肠

正确答案：E。降结肠和乙状结肠

解析：肠系膜下动脉分支给降结肠和乙状结肠提供血液，当下动脉起始部闭塞时，其分支血流不足，则降结肠和乙状结肠(E对)可能会出现血运障碍。